心理咨询的基本过程除外
A. 问题探索阶段
B. 分析认识阶段
C. 临床检查阶段
D. 治疗行动阶段
E. 结束巩固阶段

正确答案：C。临床检查阶段

解析：心理咨询的基本过程：1)问题探索阶段。2)分析认识阶段。3)治疗行动阶段。4)结束巩固阶段。C项为干扰项，不属于心理咨询的基本过程。掌握“临床心理咨询”知识点。